常于秋季发病，儿童和青年人多见，起病缓慢，阵发性干咳、发热、肌痛，胸片示下叶间质性肺炎改变
A. 支气管哮喘
B. 喘息型慢性支气管炎
C. 支气管肺癌
D. 肺炎支原体肺炎
E. 克雷伯杆菌肺炎

正确答案：D。肺炎支原体肺炎

解析：肺炎支原体肺炎（D对）以儿童和青年人居多，秋冬季节发病较多，起病较缓慢，症状主要为发热、肌痛、咳嗽，多为阵发性刺激性呛咳，胸片常为间质性肺炎改变。支气管哮喘（P28）（A错）临床表现为反复发作的喘息、气急、胸闷或咳嗽等症状，常在夜间及凌晨发作或加重，起病较急，与患者起病缓慢的表现不符。喘息性慢性支气管炎（B错）缓慢起病，病程长，主要症状为咳嗽、咳痰，或伴有喘息，由于该病为支气管炎症，胸片可见肺纹理增粗、紊乱等改变，而非叶间质性肺炎改变。支气管肺癌（P77）（C错）临床表现为咳嗽、痰血或咯血、气短或喘息、发热、体重下降，胸片可见倒S状阴影或呈圆形或类圆形的肿瘤阴影，伴有脐凹或细毛刺，而不会出现叶间质性肺炎的表现，发病也无季节性。肺炎克雷伯杆菌肺炎（E错）起病急、寒战、高热、全身衰竭、咳砖红色胶冻状痰，胸片示肺叶或肺段实变，蜂窝状脓肿，叶间隙下坠，与该患者起病缓慢及胸片呈间质性肺炎改变不符，发病也无季节性。